热射病的发病机制
A. 散热障碍
B. 水盐失衡
C. 脑供血不足
D. 太阳辐射过强

正确答案：A。散热障碍

解析：本题考查热射病的发病机制。热射病是指在热环境下作业时，人体内部和外部总体热负荷超过了散热能力，导致身体过热（A对BCD错）所致。其临床特点为突然发病，体温升高可达40℃以上，开始时大量出汗，以后出现“无汗”，可伴有皮肤干热及意识障碍、嗜睡、昏迷等中枢神经系统症状。热射病发作时，机体的散热系统处于崩溃状态，无法有效进行散热。